慢性增殖型口腔念珠菌病的典型临床表现是
A. 舌背黏膜呈鲜红色，并有舌乳头萎缩
B. 义齿承托区黏膜呈亮红色
C. 口角内侧三角区充血伴颗粒增生
D. 口腔黏膜充血，出现凝乳状斑片
E. 口角区黏膜湿白、糜烂、皲裂

正确答案：C。口角内侧三角区充血伴颗粒增生

解析：本题考查口腔念珠菌病。慢性增殖型口腔念珠菌病的典型临床表现是口角内侧三角区充血伴颗粒增生（C对）。慢性增殖型念珠菌病的临床表现：又称慢性肥厚型念珠菌性口炎、念珠菌性白斑。多见于颊黏膜、舌背及腭部。本型的颊黏膜病损，常对称位于口角内侧三角区，呈结节状或颗粒状增生，或为固着紧密的白色角质斑块，类似一般黏膜白斑。腭部损害可由义齿性口炎发展而来，黏膜呈乳头状增生。肥厚型念珠菌性口炎，可作为慢性黏膜皮肤念珠菌病症状的一个组成部分，也可见于免疫不全综合征和内分泌功能低下的患者。